女，42岁，患2型糖尿病5年，孕39+2周，宫高腹围B超估算胎儿体重4500克，原因是
A. 高胰岛素促进蛋白和脂肪合成，抑制脂肪分解
B. 高胰岛素促进蛋白合成，促脂肪分解
C. 高胰岛素促进蛋白和脂肪合成，促进脂肪分解
D. 高胰岛素促进蛋白和脂肪合成，促蛋白分解
E. 高胰岛素促脂肪合成，蛋白质分解

正确答案：A。高胰岛素促进蛋白和脂肪合成，抑制脂肪分解

解析：胎儿长期处于母体高血糖所致的高胰岛素血症环境中，促进蛋白、脂肪合成和抑制脂解作用（A对），导致躯体过度发育。